对乙酰氨基酚的鉴别反应为
A. 与三氯化铁试液反应后呈色
B. 直接或水解后，重氮化-偶合反应呈色
C. 两者均可
D. 两者均不可

正确答案：C。两者均可

解析：本题考查常用的药品鉴别方法。对乙酰氨基酚具有酚羟基，其水溶液加三氯化铁试液即显蓝紫色。对乙酰氨基酚具有潜在的芳伯氨基，在稀盐酸中加热水解生成对氨基酚，后者具有游离的芳伯氨基，在酸性溶液中与亚硝酸钠试液进行重氮化反应，生成的重氮盐再与碱性β-萘酚偶合生成红色偶氮化合物（C对）。